下列呼吸困难常伴“三凹征”的是
A. 吸气性呼吸困难
B. 呼气性呼吸困难
C. 心源性呼吸困难
D. 血源性呼吸困难
E. 中毒性呼吸困难

正确答案：A。吸气性呼吸困难

解析：本题考查各种呼吸困难的鉴别诊断。常伴“三凹征”的呼吸困难是吸气性呼吸困难（A对）。吸气性呼吸困难：表现为喘鸣、吸气时胸骨、锁骨上窝及肋间隙凹陷—三凹征。常见于喉、气管狭窄，如炎症、水肿、异物和肿瘤等。下呼吸道阻塞病人，因气流呼出不畅，呼气需要用力，从而引起肋间隙膨隆，因呼气时间延长，又称之为呼气性呼吸困难（B错），常见于支气管哮喘和慢性阻塞性肺疾病。心源性呼吸困难（C错）：指由于各种原因的心脏疾病发生左心功能不全时，患者自觉呼吸时空气不足，呼吸费力的状态；依照严重程度可表现为：劳力性呼吸困难、阵发性夜间呼吸困难、心源性哮喘、端坐呼吸、急性肺水肿；听诊肺底部可出现中、小湿锣音，并随体位而变化。血源性呼吸困难（D错）：重症贫血可因红细胞减少，血氧不足而致气促，尤以活动后显剧；大出血或休克时因缺血及血压下降，刺激呼吸中枢而引起呼吸困难。中毒性呼吸困难（E错）：各种原因所致的酸中毒，均可使血中二氧化碳升高、pH降低，刺激外周化学感受器或直接兴奋呼吸中枢，增加呼吸通气量，表现为深而大的呼吸困难；呼吸抑制剂如吗啡、巴比妥类等中毒时，也可抑制呼吸中枢，使呼吸浅而慢。